有关急性化脓性骨髓炎正确的
A. 仅发生上颌
B. 无牙齿松动
C. 无张口受限
D. 可并发败血症
E. 全身症状不明显

正确答案：D。可并发败血症

解析：本题考查急慢性化脓性颌骨骨髓炎。急性化脓性颌骨骨髓炎局部和全身症状明显（E错），可并发败血症（D对）、颅内感染等。患部剧烈疼痛，可出现多个牙松动（B错）。发生于上颌者，可并发上颌窦炎。发生于下颌者（A错），炎症较弥散、广泛，可出现下唇麻木，若炎症侵犯咀嚼肌时，可引起张口受限（C错）。